前瞻性队列研究与流行病学实验的根本区别是
A. 是否人为控制研究条件
B. 是否设立对照组
C. 是否进行显著性检验
D. 是否在现场人群中进行
E. 是否检验病因假设

正确答案：A。是否人为控制研究条件

解析：本题考查实验流行病学和观察法的区别。实验流行病学不同于描述性和分析性流行病学，后者在研究实施中只是描述或分析人群中的某些现象，从中找出规律性的结论，属于观察法。而实验流行病学则属于实验法，即有人为给予的干预措施（A对BCDE错），并强调随机分配。前瞻性队列研究属于分析性研究，也是观察法的范畴。